根据《药品生产质量管理规范》，企业应当针对影响药品质量的所有因素建立药品质量风险管理体系，确保药品质量符合预定用途。下列行为中，符合《药品生产质量管理规范》的有
A. 丁药品生产企业设立独立的质量管理部门，负责审核所有与质量有关的文件
B. 丙药品生产企业组织所有员工接受卫生要求的培训，建立人员卫生操作规程
C. 乙药品生产企业在质量管理部门设立不良反应报告和管理部门，由质量受权人兼职负责管理
D. 甲药品生产企业2019年1月1日生产的批号为20190001的阿奇霉素注射液，有效期至2021年12月。2021年12月30日该企业对该批次药品的批记录进行集中销毁

正确答案：A、B。丁药品生产企业设立独立的质量管理部门，负责审核所有与质量有关的文件；丙药品生产企业组织所有员工接受卫生要求的培训，建立人员卫生操作规程

解析：本题考查的是从事药品生产应具备的条件。根据《药品生产质量管理规范》，企业应当针对影响药品质量的所有因素建立药品质量风险管理体系，确保药品质量符合预定用途。下列行为中，符合《药品生产质量管理规范》的有丁药品生产企业设立独立的质量管理部门，负责审核所有与质量有关的文件（A对）；丙药品生产企业组织所有员工接受卫生要求的培训，建立人员卫生操作规程（B对）。药品生产企业从事药品生产应具备的条件：从事药品生产应当符合以下条件：1.有依法经过资格认定的药学技术人员、工程技术人员及相应的技术工人，法定代表人、企业负责人、生产管理负责人（以下称生产负责人）、质量管理负责人（以下称质量负责人）、质量受权人及其他相关人员符合《药品管理法》《疫苗管理法》规定的条件。2.有与药品生产相适应的厂房、设施、设备和卫生环境。3.有能对所生产药品进行质量管理和质量检验的机构、人员。4.有能对所生产药品进行质量管理和质量检验的必要的仪器设备。5.有保证药品质量的规章制度，并符合药品生产质量管理规范要求。从事疫苗生产活动的，还应当具备下列条件：1.具备适度规模和足够的产能储备。2.具有保证生物安全的制度和设施、设备。3.符合疾病预防、控制需要。药品上市许可持有人应当指定药品不良反应监测负责人，设立专门机构，配备专职人员（C错），建立健全相关管理制度，直接报告药品不良反应，持续开展药品风险获益评估，采取有效的风险控制措施。药品标签中的有效期若标注到日，应当为起算日期对应年月日的前一天；若标注到月，应当为起算月份对应年月的前一月（D错）。